能够发生甾体母核显色反应的结构类型有
A. 生物碱类
B. 甲型强心苷类
C. 乙型强心苷类
D. 香豆素类
E. 木脂素类

正确答案：B、C。甲型强心苷类；乙型强心苷类

解析：本题考查的是强心苷的显色反应。能够发生甾体母核显色反应的结构类型有甲型强心苷元（B对）与乙型强心苷元（C对）。甲型强心苷元与乙型强心苷元均含甾体母核，能够发生颜色反应，甾体类化合物在无水条件下用酸处理，能产生各种颜色反应。生物碱类（A错）的显色反应：某些生物碱能与生物碱显色剂生成不同颜色的产物。香豆素类（D错）的显色反应：可用于检识香豆素的存在和识别某位有取代的香豆素。木脂素类（E错）的显色反，2022年考试指南未明确说明。